躯体运动神经末梢释放的递质是
A. 乙酰胆碱
B. 多巴胺
C. 去甲肾上腺索
D. 甘氨酸
E. 肾上腺素

正确答案：A。乙酰胆碱